CTL通常是指
A. B淋巴细胞
B. CD8+T细胞
C. 巨噬细胞
D. 肥大细胞
E. CD4+T细胞

正确答案：B。CD8+T细胞

解析：本题考查细胞毒性T细胞。CTL通常是指CD8+T细胞（B对）。B淋巴细胞（A错）是由不如动物骨髓中的淋巴样干细胞分化而来，可通过抗体发挥特异性体液免疫功能，同时也是重要的抗原提呈细胞，并参与免疫调节。巨噬细胞（C错）是单核细胞从血液移行到全身组织器官，其主要生物学功能为杀伤清除病原体，杀伤胞内寄生菌和肿瘤等靶细胞，参与炎症反应，加工提呈抗原启动适应性免疫应答，免疫调节作用等。肥大细胞（D错）主要分布于呼吸道、胃肠道和泌尿生殖道的黏膜上皮及皮肤下的结缔组织内靠近血管处，参与I型超敏反应。CD4+T细胞（E错）通常是指Th（辅助T细胞）。